地方性氟中毒发病较轻的情况是
A. 营养状况不佳
B. 饮水的钙离子浓度低
C. 饮水的硬度小
D. 饮水的pH低
E. 饮水中镁离子低

正确答案：D。饮水的pH低

解析：本题考查地方性氟中毒发病较轻的情况。地方性氟中毒是由于一定地区的环境中氟元素过多，而致生活在该环境中的居民经饮水、食物和空气等途径长期摄入过量氟所引起的以氟骨症和氟斑牙为主要特征的一种慢性全身性疾病。地方性氟中毒的发生受一些因素影响，比如饮水pH低（D对）的地区氟中毒发病较轻。而营养状况不佳（A错）、含钙、镁离子较低（BE错）、硬度小（C错）的饮水型病区患病率高，病情较严重。